女，59岁。右上腹剧痛15天，伴发热10天。乙肝病史10年，慢性支气管炎病史8年。查体：T38.3℃，慢性病容，颈静脉无怒张，双肺呼吸音减弱，未闻及湿啰音，腹膨隆，肝右肋下4cm，双下肢凹陷性水肿。肝功能检查正常。该患者肝大最可能的原因是：
A. 右心功能不全
B. 淋巴瘤
C. 胆道感染
D. 肝脓肿
E. 肝癌

正确答案：D。肝脓肿

解析：患者右上腹剧痛，发热，肝大，双下肢凹陷性水肿，肝功正常，应诊断为肝脓肿（D对）。右心功能不全（A错）应有颈静脉怒张。淋巴瘤（B错）有淋巴结肿大和发热、盗汗、瘙痒、消瘦等全身症状。胆道感染（C错）常有黄疸。肝癌（E错）少有发热。